男性，60岁。诉左下后牙咀嚼疼痛。口腔检查：左下6牙体无明显病变，颊侧牙周袋深6mm，牙龈退缩可见根分叉区完全开放，探针能水平通过分叉区，X线片示：根分叉区完全开放。按Glickman根分叉病变分类法，属于
A. Ⅰ类根分叉病变
B. Ⅱ类根分叉病变
C. Ⅲ类根分叉病变
D. Ⅳ类根分叉病变
E. 正常

正确答案：D。Ⅳ类根分叉病变

解析：本题考查根分叉病变的临床表现。该患者有颊侧深牙周袋，且牙龈退缩而使根分叉区完全开放，探针能水平通过分叉区，X线片可见根分叉区完全开放，患者的临床表现符合Ⅳ类根分叉病变（D对）的特点。Ⅰ类根分叉病变（A错）属于病变早期，根分叉区的骨质吸收很轻微，虽然从牙周袋内已能探到根分叉的外形，但尚不能水平探入分叉内，通常在X线片上看不到改变。Ⅱ类根分叉病变（B错）表现为在多根牙的一个或一个以上的分叉区内已有骨吸收，但尚未与对侧相通，用牙周探针或弯探针可从水平方向部分进入分叉区内，X线片一般仅显示分叉区有局限的牙周膜增宽或骨质密度有小范围的降低。Ⅲ类根分叉病变（C错）根分叉区的牙槽骨全部吸收，形成贯通性病变，探针能水平贯通分叉区，但它仍被牙周袋软组织覆盖而未直接暴露于口腔，而在本题中牙龈退缩可见根分叉区完全开放。正常情况下，根分叉区充满着牙槽骨间隔，从龈沟内是探不到分叉区的，但该患者根分叉区完全开放，探针能水平通过分叉区，故患牙根分叉区不是正常（E错）的形态结构。